有关糖异生描述有误的是
A. 糖异生途径基本是糖酵解的逆反应过程
B. 糖酵解途径中绝大多数反应是不可逆的
C. 由磷酸果糖激酶催化的反应是不可逆的
D. 由丙酮酸激酶催化的反应是不可逆的
E. 由己糖激酶催化的反应是不可逆的

正确答案：B。糖酵解途径中绝大多数反应是不可逆的

解析：糖异生途径基本是糖酵解的逆反应过程。糖酵解途径中大多数反应是可逆的，但由己糖激酶、磷酸果糖激酶和丙酮酸激酶催化的反应是不可逆的，必须通过其他的酶催化，才能越过这三个不可逆反应进行糖异生。掌握“糖原与糖异生”知识点。